患者，男性，35岁，近3个月来经常感到不明原因地紧张、害怕、思虑多，不能控制地胡思乱想，但想法是自己的。患者为此感到苦恼，主动就诊。患者存在的主要症状是
A. 焦虑症状
B. 强迫症状
C. 强制思维
D. 恐惧症状
E. 惊恐发作

正确答案：A。焦虑症状